某女，40岁。按甘草附子汤的组方取药，药师嘱其所用制附子应先煎之后与他药共煎。制附子先煎的目的是
A. 长时间煎煮可提高乌头碱的溶出量
B. 制附子中的化学成分水溶性差，需要长时间溶解
C. 长时间煎煮促使制附子中生物碱与有机酸成盐，有利于溶出
D. 长时间煎煮会促使制附子中苯甲酸与生物碱合成酯有利于吸收
E. 制附子中的二萜双酯型生物碱有很强的毒性，长时间煎煮可降低毒性

正确答案：E。制附子中的二萜双酯型生物碱有很强的毒性，长时间煎煮可降低毒性

解析：本题考查的是川乌的炮制原理。制附子先煎的目的是制附子中的二萜双酯型生物碱有很强的毒性，长时间煎煮可降低毒性（E对）。川乌中主要毒性生物碱在炮制过程中的变化：乌头碱、次乌头碱、新乌头碱等为双酯型生物碱，具麻辣味，毒性极强，是乌头的主要毒性成分。若将双酯型生物碱在碱水中加热，或将乌头直接浸泡于水中加热，或不加热仅在水中长时间浸泡，都可水解酯基，生成单酯型生物碱或无酯键的醇胺型生物碱。如乌头碱水解后生成的单酯型生物碱为乌头次碱，无酯键的醇胺型生物碱为乌头原碱。单酯型生物碱的毒性小于双酯型生物碱，而醇胺型生物碱几乎无毒性，但它们均不减低原双酯型生物碱的疗效。这就是乌头及附子经水浸、加热等炮制后毒性变小的化学原理。